妊娠合并糖尿病什么情况要进行剖宫产
A. 巨大胎儿
B. 胎盘功能不良
C. 胎位异常
D. 其他产科指征者
E. 以上全是

正确答案：E。以上全是